男，60岁。因胃溃疡合并多次大出血，行胃大部切除术。如果病人发生残胃癌，时间至少超过术后
A. 1年
B. 2年
C. 3年
D. 4年
E. 5年

正确答案：E。5年

解析：残胃癌指因良性病变施行胃大部切除术后残胃出现的原发癌，如果病人发生残胃癌，时间至少要超过术后5年（E对）。